维生素D缺乏性佝偻病的病因不包括
A. 日光照射不足
B. 未行母乳喂养
C. 生长发育过快
D. 疾病影响
E. 维生素D摄入不足

正确答案：B。未行母乳喂养

解析：维生素D缺乏性佝偻病的病因：①围生期维生素D不足；②日照不足（A对）；③维生素D摄入不足（E对）；④生长过速（C对），是因为早产儿、双胎婴儿体内维生素D储备不足，而出生后期生长速度较快，需要量大所致；⑤疾病因素（D对），是因为肝胆、肠道的慢性疾病会影响维生素D的吸收、利用；严重的肝、肾疾病亦可导致维生素D羟化障碍、生成量不足而引起；⑥药物影响，某些药物加速维生素D的分解代谢。母乳中维生素含量本来较少，故不是本病的病因（B错，为本题正确答案）。